急性胰腺炎的典型症状是
A. 上腹部烧灼样疼痛，进食后可缓解
B. 上腹部持续性剧烈疼痛，向腰背部放射
C. 阵发上腹部钻顶样疼痛，辗转体位
D. 脐周阵发性疼痛，停止排便和排气
E. 上腹部剧烈疼痛，向左上臂内侧放射

正确答案：B。上腹部持续性剧烈疼痛，向腰背部放射

解析：胰腺受交感神经和副交感神经双重支配，交感神经支配胰腺的感觉，副交感神经支配腺泡、胰岛和腺管的分泌。胰腺的感觉纤维经腹腔神经丛传入第5～9或第10胸髓节段，因此急性胰腺炎时，胰腺内部炎症、胰酶激活等刺激产生的疼痛感觉表现为上腹部持续性剧烈疼痛，向腰背部放射（B对）。上腹部烧灼样疼痛，进食后可缓解（A错）为十二指肠溃疡的典型症状。阵发上腹部钻顶样疼痛，辗转体位（C错）为胆道蛔虫症（P447）的典型症状。脐周阵发性疼痛，停止排便和排气（D错）为机械性肠梗阻（P358）的典型症状。上腹部剧烈疼痛，向左上臂内侧放射（E错）为稳定性心绞痛（九版内科学P219）的疼痛特点之一。